被首选用于治疗手背肿痛、烦热目痛、毒蛇咬伤的腧穴是
A. 外劳宫
B. 十宣
C. 四缝
D. 中魁
E. 八邪

正确答案：E。八邪

解析：八邪为常用经外奇穴，主治手背肿痛，手指麻木，烦热，目痛、毒蛇咬伤（E对）；外劳宫（A错）主治落枕、脐风、手指肿痛；十宣（B错）主治昏迷、癫痫、咽喉肿痛、手指麻木；四缝（C错）主治小儿疳积、百日咳；中魁（D错）主治脾胃系疾病，打嗝、呕吐等。